应激时下列何种激素可降低
A. 胰高血糖素
B. 胰岛素
C. 催乳素
D. ADH
E. β-内啡肽

正确答案：B。胰岛素

解析：胰岛素（B对）应激时降低。